以下与《中国防治慢性病中长期规划（2017-2025年）》中提出的策略不完全相符的是
A. 加强健康教育，控制个体危险因素
B. 实施早诊早治，降低高危人群发病风险
C. 强化规范诊疗，提高治疗效果
D. 统筹社会资源，创新驱动健康服务业发展
E. 增强科技支撑，促进监测评价和研发创新

正确答案：A。加强健康教育，控制个体危险因素

解析：本题考查《中国防治慢性病中长期规划（2017-2025年）》中提出的策略。《中国防治慢性病中长期规划（2017-2025年）》中提出的策略包括：①加强健康教育，提升全民健康素质（A错，为本题正确答案）。②实施早诊早治，降低高危人群发病风险（B对）。③强化规范诊疗，提高治疗效果（C对）。④促进医防协同，实现全流程健康管理。⑤完善保障政策，切实减轻群众就医负担。⑥控制危险因素，营造健康支持性环境。⑦统筹社会资源，创新驱动健康服务业发展（D对）。⑧增强科技支撑，促进监测评价和研发创新（E对）。